五阴煎加味适用于急性白血病的哪种证型
A. 热毒炽盛
B. 气阴两虚
C. 痰热瘀阻
D. 阴虚火旺
E. 气营两燔

正确答案：B。气阴两虚

解析：五阴煎加味可以益气养阴，清热解毒，故用于治疗急性白血病气阴两虚证（B对）。热毒炽盛证（A错），治法为清热解毒，凉血止血，方药用黄连解毒汤合清营汤加减。痰热瘀阻证（C错）治法为清热化痰，活血散结，方药用温胆汤合桃红四物汤加减。阴虚火旺证（D错）治法为滋阴降火，凉血解毒，方药用知柏地黄丸合二至丸加减。气营两燔证（E错）不属于急性白血病的证型。